颌面部绷带最常使用的绷带是
A. 卷带
B. 三角巾
C. 四头带
D. 石膏绷带
E. 弹性吊颌帽

正确答案：A。卷带

解析：本题考查绷带的选择。颌面部绷带最常使用的绷带是卷带（A对）。卷带是由纱布或普通棉布裁成长条卷成，是一种应用最为广泛的绷带，可适应各种部位的伤口包扎；颌面部常用宽8～10 cm，长5m左右的卷带。绷带的种类较多，包扎方法有多种，可根据创口的部位、特点等选择适宜的绷带和包扎方法。三角巾（B错）可对全身各部位进行止血和包扎，尤其是对肩部、胸部、腹股沟部和臀部等不易包扎的部位使之变得简单易行，在口腔颌面外科全麻手术中也可作为包头巾使用。四头带（C错）常用于包扎鼻部、下颌、颏部创口，也用于压迫术后创口。石膏绷带（D错）用途很广，在颌面部常用于制作石膏帽，以利颌骨骨折的牵引复位、固定。弹性吊颌帽（E错）常用于上、下颌骨骨折的固定。